有关医疗用毒性药品和放射性药品储存的描述，正确的有
A. 毒性药品应专库（柜）储存
B. 单品种少量毒性药品可暂存于贵重药品柜中
C. 毒性药品与麻醉药品可同库（柜）储存
D. 毒性药品实行双人、双锁管理制度
E. 放射性药品应放置在铅容器内

正确答案：A、D、E。毒性药品应专库（柜）储存；毒性药品实行双人、双锁管理制度；放射性药品应放置在铅容器内